将一种大气污染物的空气质量标准定在“大于此种浓度和接触时间内，对感觉器官有刺激，对某些植物有损害或对环境产生其他有害作用”这一级上。该级属WHO标准的
A. 第一级
B. 第二级
C. 第三级
D. 第四级
E. 第五级

正确答案：B。第二级

解析：本题考查环境空气质量标准。将一种大气污染物的空气质量标准定在“大于此种浓度和接触时间内，对感觉器官有刺激，对某些植物有损害或对环境产生其他有害作用”这一级上。该级属WHO标准的第二级（B对ACDE错）。